在判断因果联系的标准中，存在剂量-反应关系表明
A. 联系的强度不明显
B. 随着暴露剂量增加（或降低）而联系强度也随之增大（或降低）
C. 疾病的患病率高
D. 疾病的发病率降低
E. 因果之间的联系存在许多偏倚

正确答案：B。随着暴露剂量增加（或降低）而联系强度也随之增大（或降低）

解析：本题考查剂量-反应关系。在判断因果联系的标准中，存在剂量-反应关系表明随着暴露剂量增加（或降低）而联系强度也随之增大（或降低）（B对ACDE错）。